患者要求前牙美观治疗，自觉自牙齿萌出后牙面有花斑，而且周围邻牙也有类似表现。查：全口牙列均可见不同程度的散在黄褐色及白垩状斑。该患牙诊断为
A. 釉质发育不全症
B. 氟牙症
C. 四环素牙
D. 浅龋
E. 遗传性乳光牙本质

正确答案：B。氟牙症

解析：氟牙症又称斑釉症，是一种特殊类型的釉质发育不全。受损牙面呈白垩色至深褐色，患牙为对称性分布，常累及全口牙齿。患者在牙齿发育矿化期有在高氟区生活的历史，这一点是与浅龋鉴别的重要参考因素。掌握“氟牙症”知识点。